齿燥如枯骨者，属
A. 热盛伤津
B. 阳明热盛
C. 肾阴枯竭
D. 胃阴不足
E. 肾气虚乏

正确答案：C。肾阴枯竭

解析：肾阴枯竭，精不上荣则见牙齿燥如枯骨，可见于温热病的晚期，属病重（C对）。胃肾热甚，热盛伤津，气津已竭，则见齿焦无垢（A错）。阳明热盛，津液大伤，则见牙齿光燥如石（B错）。胃阴已伤，胃阴不足，则见牙齿干燥（D错）。肾虚或胃阴不足，虚火燔灼，龈肉失养，则见牙宣（龈肉萎缩，牙根暴露，牙齿松动，常有渗血和脓液）（E错）。